反映某暴露因素与疾病关联强度的最好的指标是
A. 人群归因危险度
B. 全人群该病的发病率
C. 该因素的流行率
D. 相对危险度
E. 归因危险度

正确答案：D。相对危险度

解析：本题考查相对危险度。相对危险度（D对ABCE错）是指暴露组发病或死亡的危险是非暴露组的多少倍，即两组危险度之比。是反映某暴露因素与疾病关联强度的最好的指标。